通过细胞膜受体发挥作用的激素是
A. 雌激素
B. 孕激素
C. 糖皮质激素
D. 甲状腺激素
E. 胰岛素

正确答案：E。胰岛素

解析：细胞的信号转导是指生物学信息（兴奋或者抑制）在细胞间或者细胞内转换和传递，并产生生物效应的过程。根据介导的受体或者配体不同，信号转导可通过两类方式进行。一类是水溶性配体或物理信号先作用于膜受体，再依次经跨膜的和细胞内的信号转导机制产生效应。根据膜受体特性的不同，这类信号转导又有多种通路，主要是由离子通道型受体、G蛋白偶联受体、酶联型受体和招募型受体介导的信号转导。其中激活酪氨酸激酶受体的配体主要是各类生长因子，包括表皮生长因子、血小板源生长因子、成纤维细胞生长因子、肝细胞生长因子和胰岛素（E对）等。另一类是脂溶性配体直接与胞质受体或核受体结合而发挥作用。核受体实质上是激素调控特定蛋白质转录的一大类转录调节因子，包括类固醇激素（如糖皮质激素（C错）受体、盐皮质激素受体、性激素（AB错）受体）、维生素D3受体、甲状腺激素（D错）受体和维甲酸受体等。